脚气病需要补充
A. 维生素B₁₂
B. 维生素B₁
C. 维生素B₆
D. 维生素A
E. 维生素D

正确答案：B。维生素B₁

解析：本题考查维生素B₁适应症。维生素B₁（B对）用于维生素B₁缺乏所致的（脚气病）或韦尼克脑病的治疗。